按Glisson系统将肝分5个叶，下列哪个不正确
A. 右前叶
B. 左内叶
C. 方叶
D. 尾状叶
E. 右后叶

正确答案：C。方叶

解析：根据Glisson系统将肝分为肝尾状叶(D对)，左外叶，左内叶(B对)，右前叶(A对)，右后叶(E对)，不包括方叶(C错，为本题正确答案)。